针刺出血试验时用的针头为
A. 5号
B. 6号
C. 7号
D. 8号
E. 9号

正确答案：C。7号

解析：本题考查皮瓣移植。针刺出血试验：对一些皮瓣颜色苍白，无法马上判断是否为动脉堵塞所致时，可采用此法。要求在无菌状态下进行，以7号（C对）针头刺入皮瓣深达0.5cm，并适当捻动针头，拔起后轻挤周围组织，如见鲜红血液流出，提示动脉血供良好，否则提示动脉危象。